患者，男性，38岁，1个月来乏力，食欲差，左上腹胀痛。查体：肝肋下3cm，脾肋下10cm，血红蛋白120g/L，白细胞260×10⁹/L，血小板210×10⁹/L，白细胞分类：中幼粒及晚幼粒细胞为主，中性粒细胞碱性磷酸酶活性减低，首选治疗
A. 羟基脲
B. 三代头孢菌素
C. 脾切除
D. DA方案
E. 保肝治疗

正确答案：A。羟基脲